用于器官移植排斥反应药物
A. 利福平
B. 利巴韦林
C. 伯氨喹
D. 氟康唑
E. 环磷酰胺

正确答案：E。环磷酰胺

解析：环磷酰胺是常用的烷化剂，是免疫抑制药，主要通过杀伤增殖期淋巴细胞发挥作用，常用于器官移植排斥反应（E对）；也可与其他抗肿瘤药物合用治疗一些恶性肿瘤。利福平（A错）是广谱抗菌药，对结核分枝杆菌、麻风杆菌、革兰氏阳性菌尤其耐药性金黄色葡萄球菌有强大的抗菌作用，较大浓度时对革兰氏阴性菌、某些病毒和沙眼衣原体也有抑制作用。利巴韦林（B错）又名病毒唑，为广谱抗病毒药，对多种RNA和DNA病毒有抑制作用。伯氨喹是抗疟药（C错），能杀灭肝脏中休眠子，控制疟疾的复发；并能杀灭各种疟原虫的配子体，控制疟疾传播。氟康唑（D错）为抗真菌药，用于真菌感染的治疗。